不属于我国计划免疫范畴的传染病是
A. 乙肝
B. 戊肝
C. 麻疹
D. 脊髓灰质炎
E. 甲肝

正确答案：B。戊肝

解析：本题考查我国计划免疫范畴的传染病。甲肝（E对）、乙肝（A对）、麻疹（C对）、脊髓灰质炎（D对）均属于我国法定乙类传染病。戊肝（B错，为本题正确答案）不属于我国计划免疫范畴的传染病。